病例对照研究中用于匹配的因素，必须是
A. 未知的混杂因素
B. 与研究的疾病无关的因素
C. 未知的暴露因素
D. 可疑的暴露因素
E. 已知或可疑的混杂因素

正确答案：E。已知或可疑的混杂因素

解析：本题考查匹配的因素。病例对照研究中用于匹配的因素必须是已知的混杂因素，或者有充分的理由怀疑为混杂因素（E对ABCD错）。